使眼球向下内转
A. 上直肌
B. 下直肌
C. 上斜肌
D. 下斜肌
E. 内直肌

正确答案：B。下直肌

解析：上直肌（A错）使眼球向上内转；下直肌（B对）使眼球向下内转；上斜肌（C错）使眼球向下外转；下斜肌（D错）使眼球向上外转；内直肌（E错）使眼球向内侧转。